含有萘环结构的药物是
A. 盐酸异丙肾上腺素
B. 盐酸麻黄碱
C. 盐酸普萘洛尔
D. 盐酸哌唑嗪
E. 硫酸沙丁胺醇

正确答案：C。盐酸普萘洛尔

解析：本题考查盐酸普萘洛尔的结构。含有萘环结构的药物是普萘洛尔（C对）。盐酸异丙肾上腺素（A错）含儿茶酚胺结构；盐酸麻黄碱（B错）含苯丙烷结构；盐酸哌唑嗪（D错）含喹唑啉结构；硫酸沙丁胺醇（E错）含有邻二酚羟基。